某女，8岁，患咳嗽、咯痰不畅，证属邪热闭肺。近日又突发痄腮肿痛，并伴便秘黄，宜选用的药是
A. 菊花
B. 西河柳
C. 牛蒡子
D. 升麻
E. 赤芍

正确答案：C。牛蒡子

解析：本题考查的是牛蒡子的主治病证。患咳嗽、咯痰不畅，证属邪热闭肺。近日又突发痄腮肿痛，并伴便秘黄，宜选用的药是牛蒡子（C对）。牛蒡子：【主治病证】（1）风热感冒，温病初起。（2）风热或肺热咳嗽、咯痰不畅，咽喉肿痛。（3）麻疹不透，风热疹痒。（4）热毒疮肿，痄腮。菊花（A错）：【主治病证】（1）风热感冒，温病初起。（2）风热或肝火上攻所致的目赤肿痛。（3）肝阴虚之眼目昏花。（4）风热头痛，肝阳头痛、眩晕。（5）热毒疮肿。西河柳（B错）：【主治病证】（1）麻疹透发不畅，风疹瘙痒。（2）风湿痹痛。升麻（D错）：【主治病证】（1）风热头痛，麻疹透发不畅。（2）热毒疮肿，丹毒，痄腮，咽喉肿痛，口舌生疮，温毒发斑。（3）气虚下陷之久泻脱肛、崩漏下血及胃下垂、子宫脱垂等。赤芍（E错）：【主治病证】（1）温病热入营血之斑疹吐衄，火热内伤之血热吐衄，皮下出血。（2）血滞之闭经、痛经，产后瘀阻，癥瘕，跌打肿痛。（3）痈肿疮毒，目赤肿痛，肝郁化火之胁痛。